急性苯中毒主要损害
A. 中枢神经系统
B. 循环系统
C. 血液系统
D. 泌尿系统
E. 呼吸系统

正确答案：A。中枢神经系统

解析：急性苯中毒是由于短时间吸入大量苯蒸汽引起。主要表现为中枢神经系统（A对）的麻醉作用。轻者出现兴奋、欣快感、步态不稳，以及头晕、头疼、恶心、呕吐，轻度意识模糊等。重者神志模糊加重，由浅昏迷进入深昏迷状态或出现抽搐。严重者致呼吸、心跳停止。苯中毒有循环系统（B错）、泌尿系统（D错）、呼吸系统（E错）的表现。慢性苯中毒以血液系统（C错）损害为主。